与补体C3b相结合的是
A. TCR-CD3复合物
B. mlg
C. FcR
D. C3bR
E. BCR复合物

正确答案：D。C3bR